根据《处方药与非处方药分类管理办法（试行）》，非处方药分为甲、乙两类，其分类依据是药品的
A. 专属性
B. 有效性
C. 安全性
D. 给药途径
E. 经济性

正确答案：C。安全性

解析：本题考查的是非处方药的分类。根据《处方药与非处方药分类管理办法（试行）》，非处方药分为甲、乙两类，其分类依据是药品的安全性（C对）。非处方药的分类：国家根据药品的安全性，非处方药又被分为甲、乙两类，就用药安全性而言，乙类非处方药相对于甲类非处方药更安全。《处方药与非处方药分类管理办法（试行）》第二条：根据药品品种、规格、适应症、剂量及给药途径（D错）不同，对药品分别按处方药与非处方药进行管理。处方药必须凭执业医师或执业助理医师处方才可调配、购买和使用；非处方药不需要凭执业医师或执业助理医师处方即可自行判断、购买和使用。